心房颤动最常见于
A. 冠心病
B. 风心病二尖瓣狭窄
C. 高心病
D. 甲亢性心脏病
E. 缩窄性心包炎

正确答案：B。风心病二尖瓣狭窄

解析：心房颤动（AF）简称房颤，是一种常见的心律失常，是指规则有序的心房电活动丧失，代之以快速无序的颤动波，是严重的心房电活动紊乱。房颤（P188）常发生于原有心血管疾病者，最常见于风心病二尖瓣狭窄（B对）。也可见于冠心病（A错）、高心病（C错）、甲亢性心脏病（D错）和缩窄性心包炎（E错），但都不及风心病二尖瓣狭窄常见。